小儿食指络脉显于气关为
A. 邪气入经
B. 邪气入络
C. 邪入脏腑
D. 邪犯皮毛
E. 邪入关节

正确答案：A。邪气入经

解析：根据络脉在食指三关出现的部位，可以测定邪气的浅深、病情的轻重。指纹达于气关，是邪气入经，邪深病重（A对）。邪气入络（B错）时指纹显于风关，邪浅病轻，可见于外感初起。邪入脏腑（C错）时指纹达于命关，病情严重。